用酸度计测定溶液的酸度，若溶液的pH值为4左右，对酸度计进行校正时需选用的标准缓冲液是
A. 邻苯二甲酸氢钾标准缓冲液（pH4.00）
B. 磷酸盐标准缓冲液（pH6.86）
C. 邻苯二甲酸氢钾标准缓冲液（pH4.00）和磷酸盐标准缓冲液（pH6.86）
D. 磷酸盐标准缓冲液（H6.86）和硼砂标准缓冲液（pH9.18）
E. 草酸三氢钾标准缓冲液（pH山.68）和磷酸盐标准缓冲液（pH6.86）

正确答案：C。邻苯二甲酸氢钾标准缓冲液（pH4.00）和磷酸盐标准缓冲液（pH6.86）